齿状韧带由什么构成
A. 后纵韧带
B. 黄韧带
C. 软脊膜
D. 硬脊膜
E. 蛛网膜

正确答案：C。软脊膜

解析：软脊膜柔软并富有血管，与脊髓表面紧密相贴。在脊髓两侧，软脊膜增厚并向外突，形成齿状韧带（C对）。